某患者经检查牙周袋底已超过膜龈联合界，最佳采用下列哪种手术方法
A. 牙龈切除术
B. 牙周翻瓣术
C. 切除性骨手术
D. 牙周袋刮治术
E. 磨牙远中楔形瓣切除术

正确答案：B。牙周翻瓣术

解析：本题考查牙周翻瓣术的适应证。某患者经检查牙周袋底已超过膜龈联合界，最佳采用牙周翻瓣术（B对）。牙周翻瓣术可用于牙周袋底超过膜龈联合界，不宜做牙周袋切除者。牙龈切除术不能用于深牙周袋，袋底超过膜龈联合者（A错），如采用牙龈切除术切除袋壁来消除牙周袋，会将角化龈完全切除。切除性骨手术是用手术方法修正病变区的牙槽骨，使之恢复正常的形态和生理功能，其目的是修正牙槽骨的边缘部分（C错）。牙周袋刮治术是用比较精细的龈下刮治器刮除位于牙周袋内根面上的牙石和菌斑（D错）。磨牙远中楔形瓣切除术是一种翻瓣术，适用于治疗最后一个磨牙远中的牙周袋（E错）。